一面有钉头，对面有相应凹窝，断面呈层叠状的药材是
A. 石膏
B. 自然铜
C. 朱砂
D. 赭石
E. 炉甘石

正确答案：D。赭石

解析：本题考查的是赭石的性状鉴别。一面有钉头，对面有相应凹窝，断面呈层叠状的药材是赭石（D对）。赭石【性状鉴别】多呈不规则扁平块状，大小不一。全体暗棕红色或灰黑色，条痕樱红色或红棕色，有的具金属光泽。一面有圆形突起，习称“钉头”，另一面与突起的相对应处有同样大小的凹窝。体重，质硬，砸碎后断面显层叠状，且每层均依“钉头”而呈波浪状弯曲，用手抚摸，则有红棕色粉末黏手，在石头上摩擦呈樱桃红色。石膏（A错）【性状鉴别】为纤维状的集合体，呈长块状或不规则块状，大小不一。类白色、灰白色或淡黄色，有的半透明；常有夹层，内藏有青灰色或灰黄色片状杂质。体重，质软，易纵向断裂；纵断面具纤维状纹理，并显绢丝样光泽。自然铜（B错）【性状鉴别】多呈方块形，直径0.2～2.5cm。表面亮淡黄色，有金属光泽，有的表面显黄棕色或棕褐色（系氧化物，即氧化铁所致），无金属光泽，具棕黑色或墨绿色细条纹及砂眼。立方体相邻晶面上条纹相互垂直，是其重要特征。条痕绿黑色或棕红色。体重，质坚硬或稍脆，易砸碎，断面黄白色，有金属光泽；或断面棕褐色，可见银白色亮星。朱砂（C错）【性状鉴别】为粒状或块状集合体，呈大小不一的块片状、颗粒状或粉末状。鲜红色或暗红色，有光泽。体重，质脆，条痕红色至褐红色。炉甘石（E错）【性状鉴别】为块状集合体，呈不规则块状，表面灰白色，淡红色，凹凸不平，多孔，似蜂窝状，显粉状，无光泽。体轻，质松，易碎。断面灰白色或淡棕色，颗粒状，并有细小孔。有吸湿性。